男孩，5岁。水肿伴尿少3天。病前2天有“上感”史。查体：BP90/60mmHg，眼睑及颜面水肿，双下肢凹陷性水肿。实验室检查：血浆白蛋白22g/L，胆固醇7.2mmol/L，肾功能正常，血C31.25g/L，PPD试验（-）。尿常规：RBC10/HP，蛋白（++++）。若患儿经治疗，尿蛋白转阴9个月，已停药。2周前出现发热、咳嗽，随后出现尿蛋白（+++）、水肿，现已无感染表现。以下治疗措施中错误的是
A. 使用免疫调节剂
B. 抗凝利尿治疗，不必限盐
C. 加用免疫抑制剂治疗
D. 本次治疗可不必使用抗生素
E. 按初次方案重新开始治疗

正确答案：B。抗凝利尿治疗，不必限盐

解析：患者儿童，有上感病史，水肿伴尿少，低蛋白血症，大量蛋白尿，高脂血症，肾功能正常，血C3正常，大量蛋白尿，这些症状符合肾病综合征表现，经过治疗后九个月又出现出现大量蛋白尿和水肿，提示又复发。抗凝利尿治疗，不必限盐不能用于该患儿的治疗，因为在有显著水肿时应短期限盐，病情缓解后不必继续限盐（B错，为本题正确答案）。使用免疫调节剂常伴感染、频复发或糖皮质激素依赖者，因此可以用于该患儿的治疗（A对）。加用免疫抑制剂治疗可以用于频繁复发，糖皮质激素依赖、耐药或严重副作用者，可以用于该患儿的治疗（C对）。本次治疗可不必使用抗生素，因为该患儿现在已无感染表现（D对）。按初次方案重新开始治疗可以用于肾病综合征复发者（E对）。